患儿，5岁。咽部红肿疼痛3日，体温39.9℃，突然肢体抽搐，两眼上翻，来院急诊。中医辨证为
A. 肝阳化风
B. 血虚生风
C. 热极生风
D. 阴虚风动
E. 血燥生风

正确答案：C。热极生风

解析：本题考查的是肝风内动证的临床表现及辨证要点。咽部红肿疼痛3日，体温39.9℃，突然肢体抽搐，两眼上翻，来院急诊。中医辨证为热极生风（C对）。肝风内动证的临床表现及辨证要点：风有内风、外风之分，一般所称肝风，均指内风而言。其症状主要以眩晕抽搐、震颤等为主。（1）肝阳化风（A错）证：临床表现常见眩晕欲仆，头胀头痛，肢麻或震颤，舌体㖞斜，舌红脉弦，甚则猝然昏倒、舌强、语言不利，或半身不遂。一般根据患者平素具有肝阳上亢的现象结合突然出现肝风内动的症状为辨证要点。（2）热极生风证：临床表现常见高热，肢体抽搐，项强，两眼上翻，甚则角弓反张，神志昏迷，舌红脉弦数。多以高热与肝风共见为辨证要点。（3）血虚生风（B错）证：临床表现常见头目眩晕，视物模糊，面色萎黄，肢体麻木或震颤，手足拘急，肌肉瞤动，脉弦细，舌淡少苔。血虚筋脉失养所表现的动风，一般以筋脉、爪甲、两目、肌肤等失去血的濡养的症状，以及全身血虚为辨证要点。阴虚风动（D错）、血燥生风（E错）的临床表现及辨证要点，2022年考试指南未明确说明。